测定肺通气效率较好的指标是
A. 潮气量
B. 肺活量
C. 时间肺活量
D. 通气/血流比值
E. 肺扩散容量

正确答案：C。时间肺活量

解析：测定肺通气效率较好的指标是时间肺活量（C对）（第1秒用力呼气量），它是指尽力最大吸气后，再尽力尽快呼气，第一秒所能呼出的最大气体量，其中FEV1/FVC的价值最大，可用来鉴别阻塞性肺疾病和限制性肺疾病。潮气量（A错）指每次呼吸时吸入或呼出的气体量，与呼吸肌收缩的强度、胸和肺的机械特性以及机体的代谢水平有关，个体差异很大，不是评价肺通气功能较好的指标。肺活量（B错）不能充分反映肺通气效率，由于测定肺活量时不限制呼气的时间，在某些肺组织弹性降低或呼吸道狭窄的患者，虽然通气功能已经受损，但是如果延长呼气时间，所测得的肺活量仍可正常。通气/血流比值（D错）和肺扩散容量（E错）是影响肺换气的因素。